正气虚弱，脏腑经络之气不足，推动激发功能减退，运化无力形成的病理变化是
A. 由虚转实
B. 真实假虚
C. 虚中夹实
D. 真虚假实
E. 因实致虚

正确答案：D。真虚假实

解析：真虚假实指病机的本质为“虚”，但表现出"实"的临床假象，一般由于正气虚弱，脏腑经络气血不足，功能减退，气化无力所致（D对）；由虚转实指本来以正气虚损为矛盾主要方面的虚性病变，转变为邪气比较突出的病变过程（A错）；真实假虚指病机的本质为“实”，但表现出“虚”的临床假象，一般由于邪气亢盛，结聚体内，阻滞经络，气血不能外达所致（B错）；虚中夹实指以正虚为主，又兼有实邪为患的病机变化（C错）；因实致虚指病证本来以邪气盛为矛盾主要方面的实性病变，转变为以正气虚损为矛盾主要方面的虚性病变的过程（E错）。